建设单位有下列违法行为之一的，应承担相应法律责任，但不包括
A. 未按照规定进行职业病危害预评价或者未提交职业病危害预评价报告，或者职业病危害预评价未经卫生行政部门审核同意，擅自开工的
B. 建设项目的职业病防护设施未按照规定与主体工程同时投入生产和使用的
C. 职业病危害严重的建设项目，其职业病防护设施设计不符合国家职业卫生标准如卫生要求施工的
D. 未按照规定对职业病防护施进行职业病危害控制效果评价，未经卫生行政部门验收或者验收不合格，擅自投入使用的
E. 未按照规定公布有关职业病防治的规章制度，操作规程，职业病危害事故应急救援措施的

正确答案：E。未按照规定公布有关职业病防治的规章制度，操作规程，职业病危害事故应急救援措施的